阿米替林中毒心衰患者选药是
A. 东茛菪碱
B. 阿托品
C. 碳酸氢钠
D. 氯米帕明
E. 毛花甘丙

正确答案：E。毛花甘丙

解析：本题考查三环类抗抑郁药中毒解救。阿米替林中毒心衰患者选药是毛花甘丙（E对）。三环类抗抑郁药中毒如发生心里衰竭，可静脉注射毒毛花苷K0.25mg或毛花苷丙0.4mg。东莨菪碱（A错）、阿托品（B错）可用于解救有机磷中毒。2%碳酸氢钠（C错）可用于有机磷中毒后洗胃。氯米帕明（D错）为三环类抗抑郁药。